患者四肢厥逆，恶寒蜷卧，呕吐不渴，腹痛下利，神衰欲寐，舌苔白滑，脉微细治疗应首选
A. 四逆汤
B. 当归四逆汤
C. 四逆散
D. 右归丸
E. 大建中汤

正确答案：A。四逆汤

解析：四肢厥逆，恶寒蜷卧为心肾阳衰，阳气不能温煦周身四末；心肾阳衰，无力鼓动血行，则脉微细；心阳衰微，神失所养，则神衰欲寐；肾阳衰微，不能暖脾，升降失调，则腹痛下利；面色苍白，口中不渴，舌苔白滑，亦为阴寒内盛之象，此为少阴病，心肾阳衰寒厥证，治以回阳救逆，方选四逆汤（A对）。当归四逆汤功用为温经散寒，养血通脉，主治血虚寒厥证（B错）。四逆散功用为透邪解郁，疏肝理脾，主治阳郁厥逆证；肝脾不和证（C错）。右归丸功用为温补肾阳，填精益髓，主治肾阳不足，命门火衰证（D错）。大建中汤功用为温中补虚，缓急止痛，主治中阳虚衰，阴寒内盛之脘腹疼痛（E错）。